腹部炎症或手术后病人取半卧位的主要原因是
A. 有利于呼吸
B. 有利于肠蠕动
C. 有利于腹膜吸收
D. 有利于伤口愈合
E. 减缓腹膜对有害物质的吸收

正确答案：E。减缓腹膜对有害物质的吸收

解析：膈下区上腹部的腹膜吸收能力强，为了减缓腹膜对有害物质的吸收(E对)，采取半卧位使有害物质流到吸收能力较差的下腹部。